男孩，14岁，进行性开口困难7年，面部明显不对称。临床检查已完全不能张口。5岁时曾发生颏部对冲性损伤。治疗方法宜采用
A. 外科手术
B. 局部理疗
C. 张口训练
D. 针灸治疗
E. 药物治疗

正确答案：A。外科手术

解析：关节内强直和关节外强直需采用外科手术治疗。掌握“颞下颌关节强直”知识点。